某地调查100人得收缩压=140mmHg、标准差=10。该地95%的人收缩压的范围是
A. 139.8～140.2
B. 120.4～159.6
C. 125.0～154.6
D. 138.0～141.9
E. 135.0～145.0

正确答案：B。120.4～159.6

解析：本题目的是要在制定的参考范围内计算一个双侧界值。题中的数据资料符合正态或近似正态分布，选用正态分布法的公式。在95%时双侧界值：平均值±1.96S计算过程：140±1.96×S=140±1.96×10=120.4～159.6（mmHg）。掌握“定量资料的统计描述和推断”知识点。